具有开窍宁神，化湿和胃功效的药物是
A. 石菖蒲
B. 苏合香
C. 麝香
D. 冰片
E. 牛黄

正确答案：A。石菖蒲

解析：石菖蒲的功效是开窍豁痰，醒神益智，化湿开胃（A对）。苏合香（B错）的功效是开窍醒神，辟秽，止痛。麝香（C错）的功效是开窍醒神，活血通经，消肿止痛。冰片（D错）的功效是开窍醒神，清热止痛。牛黄（E错）的功效是凉肝熄风，清热豁痰，开窍醒神，清热解毒。